下列哪项措施不是一级预防
A. 定期复查
B. 预防接种
C. 消除病因
D. 保护环境

正确答案：A。定期复查

解析：本题考查一级预防。第一级预防又称病因预防，是在疾病（或伤害）尚未发生时针对病因或危险因素采取措施，降低有害暴露的水平，增强个体对抗有害暴露的能力，预防疾病（或伤害）的发生，或至少推迟疾病的发生。预防接种（B对）、消除病因（C对）、保护环境（D对）均是一级预防的措施。定期复查（A错，为本题正确答案）属于二级预防措施。